慢性根尖周炎中最多见的是
A. 慢性根尖周脓肿
B. 慢性根尖周肉芽肿
C. 慢性根尖周囊肿
D. 致密性骨炎
E. 慢性牙槽脓肿

正确答案：B。慢性根尖周肉芽肿

解析：本题考查急慢性根尖周炎。慢性根尖周炎中最多见的为慢性根尖周肉芽肿（B对），也是慢性根尖周炎的主要病变类型。